患者因窦性心动过缓服用阿托品，感到口干和便秘，这些属于药品的
A. 毒性反应
B. 副作用
C. 后遗效应
D. 停药反应
E. 超敏反应

正确答案：B。副作用